主含含水硅酸镁[Mg₃（Si₄O₁₀）（OH）₂]的矿物药是
A. 雄黄
B. 炉甘石
C. 滑石
D. 硫黄
E. 芒硝

正确答案：C。滑石

解析：本题考查的是滑石的来源。主含含水硅酸镁[Mg₃（Si₄O₁₀）（OH）₂]的矿物药是滑石（C对）。滑石：【来源】为硅酸盐类矿物滑石族滑石。主要含含水硅酸镁[Mg₃（Si₄O₁₀）（OH）₂]。雄黄（A错）：【来源】为硫化物类矿物雄黄族雄黄。主含二硫化二砷（As₂S₂）。炉甘石（B错）：【来源】为碳酸盐类矿物方解石族菱锌矿。主含碳酸锌（ZnCO₃）。硫黄（D错）：【来源】为自然元素类矿物硫族自然硫；或用含硫矿物经加工制得。主含硫（S）。芒硝（E错）：【来源】为硫酸盐类矿物芒硝族芒硝，经加工精制而成的结晶体。主含含水硫酸钠（Na₂SO₄·10H₂O）。